低钾血症时，最早出现的临床表现是
A. 心电图改变
B. 肌乏力
C. 口苦、恶心
D. 心脏传导阻滞
E. 心脏节律异常

正确答案：B。肌乏力

解析：低钾血症患者最早出现的临床表现为肌无力（B对），先是四肢软弱无力，然后累及躯干和呼吸肌，可导致呼吸困难甚至窒息。低钾血症患者还可出现厌食、恶心、口苦、呕吐等表现（C错）；心脏受累主要表现为传导阻滞（D错）和节律异常（E错），并会出现相应的典型心电图表现（A错），但这些表现均不是低钾血症患者最早出现的表现。